男，50岁，湖北渔民。腹胀、乏力、纳差3年，尿少、全身浮肿1个月。无饮酒史及病毒性肝炎史。查体：T36.2℃，慢性病容，消瘦，巩膜无黄染，有蜘蛛痣，腹膨隆，脾肋下平脐，腹水征（+），下肢凹陷性水肿。最可能的诊断是
A. 丙肝肝硬化
B. 结核性腹膜炎
C. 乙肝肝硬化
D. 血吸虫病
E. 结肠癌

正确答案：D。血吸虫病

解析：患者中年男性，渔民（接触疫水史）。无饮酒史及病毒性肝炎史（初步排除肝炎致肝硬化）（AC错）。腹胀、乏力、纳差3年，尿少、全身浮肿1个月。查体：T36.2℃，慢性病容，消瘦，巩膜无黄染，有蜘蛛痣，腹膨隆，脾肋下平跻，腹水征（+），下肢凹陷性水肿（肝硬化腹水表现，慢性血吸虫病肝功能损害不如肝炎致肝硬化明显）。根据患者的病史、症状和体征，最可能的诊断是血吸虫病（D对）。结肠癌（E错）主要累及结肠，患者早期无明显症状，发展后可有排便习惯改变，粪便性状改变，腹痛、腹部肿块等结肠相关症状。结核性腹膜炎（B错）患者多有结核接触史，有肺结核、肠结核的等原发感染灶，患者低热、盗汗等全身中毒症状明显。